患者，女，30岁，曾外伤，患慢性牙周炎，牙龈萎缩，上颌2-2缺失，其余牙健康。患者要求美观，医师可摘局部义齿修复。肯氏分类设计为
A. 第一类
B. 第二类
C. 第三类
D. 第四类
E. 第一类的第一亚类

正确答案：D。第四类

解析：第四类：单个越过中线的缺隙，位于所有余留牙的近中。掌握“局部义齿类型，肯氏分类及模型观测”知识点。